依照《野生药材资源保护管理条例》及《国家重点保护野生药材物种名录》，没有列入《国家重点保护野生药材物种名录》的植物药材是
A. 羚羊角
B. 龙胆
C. 穿山甲
D. 当归
E. 水牛角

正确答案：D。当归